谷类脂肪含量普遍较低，主要集中在
A. 谷皮和糊粉层
B. 胚乳和胚芽
C. 糊粉层和胚芽
D. 谷皮和胚芽
E. 糊粉层和胚乳

正确答案：C。糊粉层和胚芽

解析：本题考查谷类脂肪主要集中的部分。谷类脂肪含量普遍较低，主要集中在糊粉层和胚芽（C对ABDE错）。